根据《处方药与非处方药流通管理暂行规定》，销售处方药和甲类非处方药的零售药店必须
A. 具有《药品经营许可证》
B. 配备驻店执业药师或药师以上药学技术人员
C. 将处方留存1年备查
D. 将口服和外用药分柜摆放
E. 配备质量授权人

正确答案：A、B。具有《药品经营许可证》；配备驻店执业药师或药师以上药学技术人员

解析：本题考查药店零售管理。根据《处方药与非处方药流通管理暂行规定》，销售处方药和甲类非处方药的零售药店必须具有《药品经营许可证》（A对）、配备驻店执业药师或药师以上药学技术人员（B对）。《处方药与非处方药流通管理暂行规定》第三章药店零售第九条：销售处方药和甲类非处方药的零售药店必须具有《药品经营企业许可证》。销售处方药和甲类非处方药的零售药店必须配备驻店执业药师或药师以上药学技术人员。《药品经营企业许可证》和执业药师证书应悬挂在醒目、易见的地方。执业药师应佩戴标明其姓名、技术职称等内容的胸卡。第十条：处方药必须凭执业医师或执业助理医师处方销售、购买和使用。执业药师或药师必须对医师处方进行审核、签字后依据处方正确调配、销售药品。对处方不得擅自更改或代用。对有配伍禁忌或超剂量的处方，应当拒绝调配、销售，必要时，经处方医师更正或重新签字，方可调配、销售。零售药店对处方必须留存2年以上备查（C错）。第十一条：处方药不得采用开架自选销售方式。第十二条：甲类非处方药、乙类非处方药可不凭医师处方销售、购买和使用，但病患者可以要求在执业药师或药师的指导下进行购买和使用。执业药师或药师应对病患者选购非处方药提供用药指导或提出寻求医师治疗的建议。第十三条：处方药、非处方药应当分柜摆放（D错）。第十四条：处方药、非处方药不得采用有奖销售、附赠药品或礼品销售等销售方式，暂不允许采用网上销售方式。第十五条：零售药店必须从具有《药品经营企业许可证》、《药品生产企业许可证》的药品批发企业、药品生产企业采购处方药和非处方药，并按有关药品监督管理规定保存采购记录备查。